GSP细则规定药品零售企业在营业店堂内应做到
A. 陈列药品按品种、规格、剂型或用途分类整齐摆放
B. 明示服务公约、公布监督电话、设置顾客意见薄
C. 陈列药品的货柜保持清洁和卫生
D. 对顾客反映的问题，及时进行处理
E. 对陈列的药品随时进行检查，用完及时上货

正确答案：A、B、C、D。陈列药品按品种、规格、剂型或用途分类整齐摆放；明示服务公约、公布监督电话、设置顾客意见薄；陈列药品的货柜保持清洁和卫生；对顾客反映的问题，及时进行处理

解析：本题考查GSP细则。GSP细则规定药品零售企业在营业店堂内应做到：陈列药品的货柜保持清洁和卫生（C对）；陈列药品按品种、规格、剂型或用途分类整齐摆放（A对）；企业应当在营业场所公布药品监督管理部门的监督电话，设置顾客意见薄（B对）；对顾客反映的问题，及时进行处理（D对）。